施拉姆双向传播模式的主要贡献是
A. 受众
B. 媒介
C. 效果
D. 信息
E. 反馈

正确答案：E。反馈